女，50岁，自觉口眼干燥半年，涎腺造影显示腮腺主导管扩张，末梢导管扩张成点状或球状。唇腺活检，镜下可见，腺体内淋巴细胞及组织细胞增生浸润。小叶内导管增生，小叶内部分腺泡消失。这是
A. 涎石症
B. 舍格伦综合征
C. 多形性腺瘤
D. 白塞综合征
E. 以上都不是

正确答案：B。舍格伦综合征

解析：本题考查舍格伦综合征。舍格伦综合征（B对）临床表现为口眼干燥，涎腺造影显示腮腺主导管扩张，末梢导管扩张成点状或球状。临床最常用的诊断方法是唇腺活检，镜下可见，腺体内淋巴细胞及组织细胞增生浸润，小叶内部分腺泡消失，小叶内导管增生。涎石症（A错）导管口黏膜红肿，挤压腺体可见少许脓性分泌物溢出，双合诊触及硬块，有压痛，进食胀痛，严重时出现“涎绞痛”。多形性腺瘤（C错）为生长缓慢的无痛肿块，不规则形，表面有结节，软硬不一，可活动，界限清楚，质地中等，多为实性组织。白塞综合征（D错）为眼-口-生殖器三联征，表现为反复发作的口腔溃疡、外阴溃疡、眼和皮肤病变、针刺试验阳性。